合理营养的基本原则不包括
A. 摄取食物应保持各种营养素的平衡
B. 食物对人体无害
C. 合理烹调加工，提高消化率，减少营养的损失
D. 食品多样化，感观性状良好，促进食欲，增加饱腹感
E. 多食用含蛋白质高的食物

正确答案：E。多食用含蛋白质高的食物

解析：平衡膳食，合理营养的基本要求：①提供种类齐全、数量充足、比例合适的营养素；②保证食物安全；③科学的烹饪加工；④合理的进餐制度和良好的饮食习惯。掌握“合理营养指导”知识点。